初戴全口义齿时，发现总义齿左右翘动，加力时患者有痛感。可能引起翘动的原因中不包括进入倒凹区基托未缓冲。在下述造成义齿翘动的原因中，首先考虑的原因应是与硬区相应的基托组织面未做缓冲。当检查出首选原因后，正确的处理方法是缓冲压痛处硬区的基托组织面。如果仍有翘动，应做的处理是
A. 重新制作义齿
B. 加衬垫底
C. 修复基托缘
D. 调（牙合）
E. 缓冲唇颊系带

正确答案：A。重新制作义齿

解析：本题考查义齿翘动的处理方法。如果经过缓冲仍有翘动，要考虑基托变形，或印模、模型不准确。若基托变形，或印模、模型不准确都很难通过单纯的调整获得较好的效果，常需要重新制作义齿（A对）。加衬垫底是在全口义齿的组织面上加上一层塑料使其充满牙槽嵴及周围组织被吸收部分的间隙，使基托组织面与周围的组织紧密贴合，增加义齿的固位力。若基托变形或印模、模型不准确，单纯的加衬垫底（B错），修复基托边缘（C错），调（牙合）（D错）与缓冲唇颊系带（E错）并不能明显的改善或修复这些原因造成的翘动。